以下哪种方法可以做到通过对一个地区、某一人群在一定时间内的某种或某些口腔疾病进行调查，获得该地区特定人群某种或某些口腔疾病的患病情况和分布特点
A. 横断面调查
B. 纵向调查
C. 常规资料分析
D. 组群调查
E. 临床试验

正确答案：A。横断面调查

解析：横断面调查可以通过对一个地区、某一人群在一定时间内的某种或某些口腔疾病进行调查，获得该地区特定人群某种或某些口腔疾病的患病情况和分布特点。掌握“口腔流行病学概述及研究方法”知识点。